关于外用膏剂中药物透皮吸收影响因素的叙述，正确的有
A. 具有适宜油、水分配系数的药物有利透皮吸收
B. 当基质的pH小于弱酸性药物的pKa或大于弱碱性药物的pKa时，有利药物吸收
C. 基质中添加适量表面活性剂、皮渗促进剂能增加药物的穿透性，有利于吸收
D. 基质与皮肤的水合作用能降低药物的渗透性
E. 除药物性质、皮肤条件、基质组成与性质外，药物浓度、应用面积以及年龄和性别等对外用膏剂中药物的透皮吸收均有一定影响

正确答案：A、B、C、E。具有适宜油、水分配系数的药物有利透皮吸收；当基质的pH小于弱酸性药物的pKa或大于弱碱性药物的pKa时，有利药物吸收；基质中添加适量表面活性剂、皮渗促进剂能增加药物的穿透性，有利于吸收；除药物性质、皮肤条件、基质组成与性质外，药物浓度、应用面积以及年龄和性别等对外用膏剂中药物的透皮吸收均有一定影响